男，24岁。颜面部水肿、肉眼血尿、伴咳嗽、痰中带血1周，少尿3天。BP160/100mmHg，尿蛋白（++），RBC20～30/HP，血Cr420μmol/L，血清抗肾小球基底膜抗体阳性。B超示双肾增大。目前最关键的治疗是
A. 血液透析
B. 泼尼松
C. 血浆置换
D. 丙种球蛋白
E. 泼尼松联合环磷酰胺

正确答案：C。血浆置换

解析：青年男性患者（急进性肾小球肾炎Ⅰ型的好发人群），颜面部水肿肉眼血尿伴咳嗽、痰中带血1周（病程短），少尿3天。BP160/100mmHg（2级高血压），尿蛋白（++），RBC20～30/HP（正常值0～3个/HP），血Cr420μmol/L【正常值（男）44～133μmol/L】（提示肾功能受损），血清抗肾小球基底膜抗体阳性（提示急进性肾小球肾炎Ⅰ型可能性大）。根据患者临床表现、病程进展及实验室检查，可初步诊断为急进性肾小球肾炎Ⅰ型。最关键的治疗是血浆置换（C对）去除患者血浆中的抗肾小球基底膜抗体阻止病情进一步发展。血液透析（A错）是急慢性肾功能衰竭患者肾脏替代治疗方式之一，可以清除体内的代谢废物、维持电解质和酸碱平衡；同时清除体内过多的水分，但无法去除血液中的抗体等大分子物质。丙种球蛋白（D错）主要用于再障等免疫缺乏的疾病。泼尼松（B错）冲击疗法疗也需辅以泼尼松及环磷酰胺常规口服治疗，不宜单用。泼尼松联合环磷酰胺（E错）主要用于Ⅱ、Ⅲ型，Ⅰ型疗效差。